细菌的遗传物质不包括
A. 质粒
B. 整合子
C. 中介体
D. 染色体
E. 转座因子

正确答案：C。中介体

解析：细菌遗传物质包括细菌核质内染色体、质粒、转位因子（或称转座因子）、整合子及噬菌体基因组等。掌握“细菌遗传变异的物质基础及机制”知识点。